关节运动叙述错误的是
A. 与关节面的形状无关
B. 沿冠状轴作屈、伸运动
C. 沿矢状轴作收、展运动
D. 沿垂直轴作旋转运动
E. 在平面关节上作滑动运动

正确答案：A。与关节面的形状无关

解析：滑膜关节的关节面的复杂形态，运动轴的数量和位置，决定了关节的运动形式和范围（A错，为本题正确答案）。屈和伸通常是指关节沿冠状轴进行的运动 （B对）。收和展是关节沿矢状轴进行的运动 （C对）。旋转是关节沿垂直轴进行的运动 （D对）。 移动是最简单的一个骨关节面在另一骨关节面的滑动 （E对）。